气陷证可见
A. 刺痛拒按，固定不移，舌暗，脉涩
B. 气短疲乏，脘腹坠胀，舌淡，脉弱
C. 胸胁胀闷窜痛，时轻时重，脉弦
D. 面色淡白，口唇爪甲色淡，舌淡，脉细
E. 少气懒言，疲乏无力，自汗，舌淡，脉虚

正确答案：B。气短疲乏，脘腹坠胀，舌淡，脉弱

解析：气陷证的证候表现为头晕眼花，气短疲乏，腹部坠胀，或久泄久痢，或见内脏下垂、脱肛、阴挺等，舌质淡嫩，脉弱。元气不足，脏腑机能减退，故气短乏力；气陷无力升举，不能维持脏器正常位置，故觉脘腹坠胀；舌淡，脉弱为气虚之象，故气陷证可见气短疲乏，脘腹坠胀，舌淡，脉弱（B对）。刺痛拒按，固定不移，舌暗，脉涩（A错）可见于血瘀证。胸胁胀闷窜痛，时轻时重，脉弦（C错）可见于气滞证。面色淡白，口唇爪甲色淡，舌淡，脉细（D错）可见于血虚证。少气懒言，疲乏无力，自汗，舌淡，脉虚（E错）可见于气不固证。